根据《执业药师资格制度暂行规定》，执业药师注册有效期及期满前再次注册的时限分别为
A. 2年；3个月
B. 3年；3个月
C. 3年；6个月
D. 5年；3个月
E. 5年；30日

正确答案：E。5年；30日

解析：本题考查的是执业药师注册要求。根据《执业药师资格制度暂行规定》，执业药师注册有效期及期满前再次注册的时限分别为5年；30日（E对）。执业药师注册要求：我国执业药师实行注册制度，国家药品监督管理局负责执业药师注册的政策制定和组织实施，指导全国执业药师注册管理工作。各省、自治区、直辖市药品监督管理部门负责本行政区域内的执业药师注册管理工作。取得执业药师职业资格的药学专业技术人员，经执业单位考核同意，通过全国执业药师注册管理信息系统向所在地注册管理机构申请注册。经批准注册者，由执业药师注册管理机构核发国家药监局统一样式的《执业药师注册证》，方可从事相应的执业活动。未经注册者，不得以执业药师身份执业。执业药师应当按照执业类别、执业单位、执业范围进行注册和执业。执业类别为药学类、中药学类、药学与中药学类；执业范围为药品生产、药品经营、药品使用以及其他需要提供药学服务的单位。机关、院校、科研单位、药品检验机构不属于规定的注册执业单位。执业药师注册执业范围为药品经营的，需在《执业药师注册证》上注明药品经营（批发）或药品经营（零售）；注册为零售连锁企业的，应在《执业药师注册证》上注明药品经营（零售），注册的执业单位应当明确到总部或门店，执业药师应当在其注册的执业单位执业。执业药师注册有效期为五年。需要延续的，应当在有效期届满三十日前，向所在地注册管理机构提出延续注册申请。